某女，35岁。素患肝火上炎，口苦尿黄，急躁。近日又见目赤肿痛、目生翳膜，宜选用的药是
A. 谷精草
B. 夏枯草
C. 青葙子
D. 木贼
E. 决明子

正确答案：C。青葙子

解析：本题考查的是青葙子的主治病证。素患肝火上炎，口苦尿黄，急躁。近日又见目赤肿痛、目生翳膜，宜选用的药是青葙子（C对）。青葙子：【主治病证】肝火上炎，目赤肿痛，目生翳膜。谷精草（A错）：【主治病证】（1）风热目赤，肿痛羞明，目生翳膜。（2）风热头痛。夏枯草（B错）：【主治病证】（1）肝阳或肝火上升之头目眩晕。（2）目赤肿痛，目珠夜痛。（3）痰火郁结之瘰疬、瘿瘤。木贼（D错）：【主治病证】（1）风热目赤，迎风流泪，翳障。（2）血热下血。决明子（E错）：【主治病证】（1）肝热或肝经风热之目赤肿痛、羞明多泪，目暗不明。（2）热结肠燥便秘。